出生后即有且终生存在的神经反射是
A. 拥抱反射
B. 膝腱反射
C. 腹壁反射
D. 握持反射
E. 觅食反射

正确答案：B。膝腱反射

解析：出生后即有且终生存在的神经反射是膝腱反射（B对）。拥抱反射（A错）、握持反射（D错）、觅食反射（E错）出生时既有但于3个月时消失。腹壁反射（C错）出生后由于肌腱反射较弱尚不稳定，于1岁左右稳定。